患者要求前牙美观治疗，自觉自牙齿萌出后牙面有花斑，而且周围邻面也有类似表现。查：全口牙列均可见不同程度的散在黄褐色及白垩状斑。该患牙诊断为
A. 釉质发育不全症
B. 氟牙症
C. 四环素牙
D. 浅龋
E. 遗传性乳光牙本质

正确答案：B。氟牙症

解析：本题考查氟牙症。患者要求前牙美观治疗，自觉自牙齿萌出后牙面有花斑，而且周围邻面也有类似表现。查：全口牙列均可见不同程度的散在黄褐色及白垩状斑。该患牙诊断为氟牙症（B对）。氟牙症发生在多数牙，表现为釉质上散在分布的白垩色到褐色的斑块，边界不明确。釉质发育不全症多发生于单个牙或一组牙，白垩色斑的边界比较明确，而且其纹线与釉质生长发育线相平行吻合（A错）。四环素牙初呈黄色，在阳光的照射下则呈明亮的黄色荧光，以后逐渐由黄色变成棕褐色或深灰色（C错）。浅龋有一定的好发部位，一般不会累及全口牙列（D错）。遗传性乳光牙本质，牙冠呈微黄色，光照下呈现乳光（E错）。